清音丸的功能是
A. 清热润肺，止咳化痰
B. 疏风清热，消肿止痛
C. 养阴生津，清热消痰
D. 清肺利咽，解毒退热
E. 清热利咽，生津润燥

正确答案：E。清热利咽，生津润燥

解析：本题考查的是清音丸的功能。清音丸的功能是清热利咽，生津润燥（E对）。清音丸：【功能】清热利咽，生津润燥。蜜炼川贝枇杷膏：【功能】清热润肺，化痰止咳（A错）。功能为疏风清热，消肿止痛（B错）、养阴生津，清热消痰（C错）或清肺利咽，解毒退热（D错）的中成药，2022年考试指南未明确说明。